生姜的功效是
A. 发汗解表
B. 温肺止咳
C. 温中止呕
D. 解半夏、天南星毒
E. 解鱼蟹毒

正确答案：A、B、C、D、E。发汗解表；温肺止咳；温中止呕；解半夏、天南星毒；解鱼蟹毒

解析：本题考查的是生姜的功效。生生姜的功效是发汗解表发汗解表（A对）、温肺止咳（B对）、温中止呕（C对）、解半夏、天南星毒（D对）与解鱼蟹毒（E对）。生姜：【功效】发汗解表，温中止呕，温肺止咳。【主治病证】（1）风寒表证。（2）胃寒呕吐。（3）风寒客肺之咳嗽。（4）解鱼蟹、半夏及天南星毒。